属于原发性皮肤损害的是
A. 痂
B. 丘疹
C. 鳞屑
D. 糜烂
E. 色素沉着

正确答案：B。丘疹

解析：本题考查原发性、继发性皮损的内容。继发性皮损是原发性皮损经过搔抓、感染、治疗处理和在损害修复过程中演变而成，痂属于继发性皮损（A错）。丘疹属于原发性皮损（B对）。鳞屑属于继发性皮损（C错）。糜烂属于继发性皮损（D错）。色素沉着属于继发性皮损（E错）。